艾滋病病毒侵入人体后主要攻击
A. 白细胞
B. 红细胞
C. 浆细胞
D. T辅助淋巴细胞
E. 巨噬细胞

正确答案：D。T辅助淋巴细胞

解析：艾滋病病毒侵入人体后主要攻击的是一种带CD4抗原的淋巴细胞（T4淋巴细胞）。这种细胞是免疫系统的基本组成部份，艾滋病病毒通过大量、不断地复制与释放，导致T4淋巴细胞大量死亡，使人体内T4淋巴细胞明显减少，感染者免疫功能遭到严重破坏，造成免疫缺陷。临床表现为各种机会性感染与肿瘤。有的发生神经系统病变或症状，可能与神经系统的机会性感染（弓形虫病、新隐球菌感染等）有关。同时可能是亲神经型艾滋病病毒株的直接作用造成的。掌握“艾滋病的口腔表征”知识点。